下列哪项不是疖病的临床特点
A. 好发于项后发际部、臀部
B. 好发于冬、春季节
C. 好发于消渴患者
D. 可发生于身体各处
E. 此愈彼起，日久不愈，反复发作

正确答案：B。好发于冬、春季节

解析：疖病主要因火热之毒为患。因气候炎热，汗出不畅，感受暑毒，暑湿热蕴蒸肌肤而成，所以好发于夏秋季节，不好发于天气寒冷的冬、春季节（B错，为本题正确答案）。疖病好发于项后发际、头面、背部、臀部（A对）。患消渴病（C对）、习惯性便秘或营养不良者易患本病。可在身体各处散发疖肿（D对），一处将愈，他处续发，或间隔周余、月余再发，反复发作，缠绵不愈（E对）。